患者女性32岁，自诉“胆小怕痛”曾有“晕针史”。检查见残根，根尖瘘管挤压无脓，治疗设计为局麻下拔除，麻醉顺利，10分钟后试麻效良好，开始操作，术中患者觉疼痛但可耐受，其后自诉头晕，胸闷，心慌，恶心，检查患者面色苍白，四肢冷而无力，脉快而弱。此时患者出现的症状是
A. 麻药中毒
B. 麻药过敏
C. 癔病发作
D. 晕厥
E. 肾上腺素反应

正确答案：D。晕厥

解析：本题考查局麻的并发症。晕厥（D对）是局麻的一个并发症，该患者局麻后头晕，胸闷，心慌，恶心，面色苍白，四肢冷而无力，脉快而弱，符合晕厥的临床表现。该患者胆小怕痛，有晕针史，这是引发晕厥的原因。晕厥还可因饥饿、疲劳及全身健康较差以及体位不良等因素引起。麻药中毒（A错）分为兴奋型与抑制型，兴奋型表现为烦躁不安、多话颤抖、恶心呕吐、气急多汗、血压升高、全身抽搐和缺氧发绀；抑制性表现为脉搏细弱、血压下降、神志不清、呼吸心跳骤停。麻药过敏（B错）分为延迟反应和即刻反应，延迟反应常是血管神经性水肿；即刻反应是用极少量药后，立即发生的类似中毒症状，表现为惊厥、昏迷、呼吸心搏骤停而死亡。癔病发作（C错）为一种精神性疾病，患者无器质性病变，但是认为自己患有某种疾病并觉得有相应的临床症状。肾上腺素反应（E错）表现为头晕、头痛、口唇苍白、血压上升、脉搏快而有力，而该患者脉快而弱。